白前的功效是
A. 降气祛痰
B. 发散表邪
C. 润肺止咳
D. 清泄肺火
E. 润肺平喘

正确答案：A。降气祛痰

解析：本题考查的是白前的功效。白前的功效是降气祛痰（A对）。白前：【功效】降气祛痰止咳。发散表邪（B错）为解表药的功效。凡以发散表邪、解除表证为主要功效的药物，称为解表药。川贝母：【功效】清热化痰，润肺止咳（C错），散结消痈。地骨皮：【功效】退虚热，凉血，清肺降火，生津。地骨皮甘寒，功能清泄肺火（D错）。桃仁：【功效】活血祛瘀，润肠通便，止咳平喘。桃仁能润肺降气、润燥滑肠而止咳平喘（E错）、通便，为治燥秘、肠痈、肺痈、咳喘所常用。